杂环胺对人致癌的主要靶器官为
A. 食道
B. 口腔
C. 胃
D. 肝
E. 肾

正确答案：C。胃